选用神阙穴常用的操作方法是
A. 灯草灸
B. 隔姜灸
C. 隔蒜灸
D. 隔盐灸
E. 隔泥灸

正确答案：D。隔盐灸

解析：隔盐灸（D对）是用干燥的食盐填敷于脐部第（神阙穴），或于盐上再置一薄姜片，上置大艾炷施灸。此法有回阳、救逆、固脱之功，多用于治疔伤寒阴证或吐泻并作、中风脱证等。注意要连续施灸，不拘壮数，以期脉起、肢温、证候改善。灯草灸（A错）又称灯草灸、油捻灸，是民间沿用已久的简便灸法。用灯心草一根，以麻油浸之，燃着后对准穴位或患处，迅速点灸皮肤，一触即起，接触皮肤时会伴有“叭”的爆体声，主要用于小儿痄腮、惊风、吐泻等。隔姜灸（B错）是将姜片置于腧穴或患处，再将文炷放在姜片上点燃施灸，常用于因寒而致的呕吐、腹痛以及风寒痹痛等。隔蒜灸（C错）操作方法与隔姜灸相同，此法有清热解毒、杀虫等作用，多用于治疗瘰疬、肺结核及肿疡初起等。隔泥灸（E错）未有记载。